积聚的病机主要是
A. 气机阻滞，瘀血内结
B. 肝脾肾受损，气滞血结，水停腹中
C. 脾肺肾功能失调，水潴体内
D. 心肝脾功能失常，水结腹内
E. 肝脾肾受损，血郁脾内

正确答案：A。气机阻滞，瘀血内结

解析：无论何种因素导致的积聚，其病机关键不离气滞血瘀，病变脏腑多属肝脾胃肠。气机阻滞，瘀血内结为其形成的病机（A对）（BCDE错）。